细胞因子的种类包括
A. 白细胞介素
B. 干扰素
C. 肿瘤坏死因子
D. 集落刺激因子
E. 以上均是

正确答案：E。以上均是